男，55岁。上腹部不适2个月。进食后饱胀，有时伴疼痛，食欲下降、乏力，症状逐渐加重。为明确诊断首选的检查是
A. 胃液分析
B. 胃镜
C. 食管24小时pH监测
D. 腹部X线片
E. 腹部CT

正确答案：B。胃镜

解析：患者中老年男性，出现上腹部不适、进食后饱胀伴疼痛、食欲下降、乏力（消化道症状）并逐渐加重，考虑所患疾病可能为慢性胃炎、胃溃疡或胃癌，为明确诊断，首选胃镜检查（B对）。胃液分析（A错）可测定基础胃酸分泌量（BAO）和最大胃酸分泌量（MAO），了解溃疡病患者胃酸分泌情况，现已少用。食管24小时pH监测（C错）多用于食管反流病的辅助诊断（P348）。腹部X线钡餐（D错）效果逊于胃镜，用于胃镜禁忌者、不愿接受胃镜检查者和没有胃镜时。腹部CT（E错）多用于腹部脏器或胃肠穿孔的的检查，一般不作为胃部相关疾病的诊断。